关于血栓闭塞性脉管炎，以下说法不正确的是
A. 男性多见
B. 发作呈对称性和间歇性
C. 起病隐匿，进展缓慢
D. 可发生肢体坏疽
E. 呈游走性

正确答案：B。发作呈对称性和间歇性

解析：血栓闭塞性脉管炎又称为Buerger病，是血管的炎性、节段性和反复发作的慢性闭塞性疾病，无对称性表现（B错，为本题正确答案），下肢中、小动静脉多受侵袭，男性青壮年多见（A对）。该疾病起病隐匿，进展缓慢（C对），多次发作后症状逐渐明显和加重。主要出现病肢怕冷，皮肤温度降低，苍白或发绀；病肢感觉异常及疼痛，早期起因于血管壁炎症刺激末梢神经，后因动脉阻塞造成缺血性疼痛，即间歇性跋行或静息痛；长期慢性缺血导致组织营养障碍改变。严重缺血者，病肢未端出现缺血性溃疡或坏疽(D对)；病肢的远侧动脉搏动减弱或消失；发病前或发病过程中出现复发性游走性浅静脉炎（E对）等临床表现。